Ig分成K、λ两个型，其依据是
A. 重链
B. 轻链
C. 可变区
D. 恒定区
E. 绞链区

正确答案：B。轻链